女，1个月。出生体重3500g，呕吐1周。生后3周左右开始溢乳，逐日加重呈喷射性呕吐，奶汁带凝块，不含胆汁。查体：体重3500g，皮肤轻度黄染，前囟稍凹，心肺无异常，上腹部蠕动波，右季肋下肿块，质较硬，光滑，移动。最可能的原因是
A. 先天性肠扭转不良
B. 先天性肥厚性幽门狭窄
C. 胃黏膜脱落
D. 胃扭转
E. 十二指肠淤滞症

正确答案：B。先天性肥厚性幽门狭窄

解析：1个月女婴，生后三周左右开始出现呕吐，进行性加重，有时呈喷射性，多发性于喂奶后半小时之内，呕吐物多为奶凝块，不含胆汁（先天性肥厚性幽门狭窄典型表现），查体：一般情况好，无脱水征，上腹部可见胃蠕动波，右上腹可触及包块（先天性肥厚性幽门狭窄典型征象），故该患儿最可能的诊断是先天性肥厚性幽门狭窄（B对）。先天性肠扭转不良呕吐物多为胆汁性的（绿色或者亮黄色呕吐物）（A错）。胃黏膜脱落一般表现为腹部上方疼痛，呈阵发性加重，伴腹胀（C错）。胃扭转典型三联征为突然发生的严重而短暂的胸部或上腹部疼痛、持续性的干呕、很少或无呕吐物、难以插入胃管（D错）。十二指肠淤滞症一般表现为恶心、呕吐、ssh上腹痛、嗳气等症状，呈间歇性发作（E错）。